下列为含有B族维生素的辅酶，例外的是
A. 磷酸吡多醛
B. 辅酶A
C. 细胞色素b
D. 四氢叶酸
E. 硫胺素焦磷酸

正确答案：C。细胞色素b